较常见阴道畸形
A. 阴蒂肥大、大阴唇融合、阴唇粘连、处女膜闭锁、先天性前庭尿瘘与粪瘘、两性畸形
B. 有先天性无阴道、阴道横隔、阴道纵隔、阴道斜隔、阴道闭锁和狭窄等。治疗常延至青春期后做手术整形
C. 双子宫、纵隔子宫、单角子宫、双角子宫等
D. 雄激素不敏感综合征
E. 特纳综合征

正确答案：B。有先天性无阴道、阴道横隔、阴道纵隔、阴道斜隔、阴道闭锁和狭窄等。治疗常延至青春期后做手术整形

解析：本题考查较常见阴道畸形。女性较常见阴道畸形有：有先天性无阴道、阴道横隔、阴道纵隔、阴道斜隔、阴道闭锁和狭窄等。治疗常延至青春期后做手术整形（B对ACDE错），如果女性出现了阴道畸形，一定要引起重视，建议及时到医院检查治疗，以免错过疾病的最佳治疗时期。